男，9个月。呕吐腹泻伴体温升高（38℃）1天，腹泻12次/天，水样便，1天前误饮不洁水。查体：皮肤弹性差，精神萎靡，眼眶及前囟凹陷，体重下降6%，中毒症状明显。实验室检查：外周血白细胞总数稍增加，淋巴细胞明显增加，大便镜检无特殊发现。该患儿的补液方案为
A. 90～120ml/kg，2：3：1液
B. 120～150ml/kg，2：3：1液
C. 120～150ml/kg，2：1液
D. 150～180ml/kg，2：3：1液
E. 150～180ml/kg，2：1液

正确答案：B。120～150ml/kg，2：3：1液

解析：患儿呈中度脱水表现，尚未出现休克表现，补液总量应为120-150ml/kg。2：1液是由2份0.9%NaCl溶液配1份1.4%NaHCO₃溶液配制而成，是等张液，常用于扩容和纠酸；目前脱水性质不明确，应选用1/2张度2：3：1液（B对）。